对败血症有确诊依据的是
A. 血常规
B. 中毒症状
C. 血培养
D. 尿常规
E. 血浆白蛋白测定

正确答案：C。血培养

解析：对于败血症，血培养和骨髓培养为确诊依据，在抗菌药物应用前、寒战、高热时不同部位采血，多次送检进行血培养；骨髓培养受抗菌药物影响比较小，因而骨髓培养可以替代或者联合血培养加以提高阳性率（C对）。血常规、中毒症可以作为诊断依据，但非确诊依据（AB错）。一般不将尿常规、血浆白蛋白测定作为实验室检查的诊断项目（DE错）。